为避免头晕和嗜睡，在带状疱疹治疗过程中，应遵循“夜间起始、逐渐加量和缓慢减量”给药原则的是
A. 阿昔洛韦
B. 普瑞巴林
C. 甲钴胺
D. 布洛芬
E. 喷昔洛韦

正确答案：B。普瑞巴林

解析：本题考查带状疱疹的用药注意事项与患者教育。加巴喷丁起始剂量为300mg/d，常用有效剂量为900～1800mg/d；呈非线性药代动力学特点，生物利用度随剂量升高而降低，个体间变异率为20%～ 30%，疗效存在封顶效应；主要不良反应为嗜睡和头晕，起始用药后需要数周缓慢滴定至有效剂量；该药物主要以原型经肾排泄，肾功能不全患者应减量。普瑞巴林（B对）起始剂量为150mg， 可在1周内增加至300mg/d，每日最大剂量为600mg/d，其药物不良反应与加巴喷丁相似。为避免头晕和嗜睡，两药在使用过程中均应遵循“夜间起始、逐渐加量和缓慢减量”的原则。